诊断尿路结石，首选的检查是
A. 腹部平片
B. B超
C. 肾动脉造影
D. 逆行输尿管肾盂造影
E. 泌尿系CT

正确答案：B。B超

解析：B超是泌尿结石患者的首选方法，能实时显示肾脏、输尿管、膀胱及其结石的形态、大小、部位的图像，优点是无创伤、简单费时少、不受结石成分的影响，不透X光及透X光结石均能检查到、能初步了解尿路积水扩张情况（B对）。